将蛋白质类食物通过胃瘘直接放入胃内引起胃液分泌的特点是
A. 量大，酸度高，消化力较弱
B. 量大，酸度高，消化力较强
C. 量大，酸度低，消化力较强
D. 量小，酸度低，消化力较弱
E. 量小，酸度低，消化力较强

正确答案：B。量大，酸度高，消化力较强

解析：消化期的胃液分泌分为头期、胃期和肠期三个时相。将蛋白质类食物通过胃瘘直接放入胃内引起的胃液分泌属于胃期胃酸分泌，胃期胃酸分泌特点是量大（约占整个消化期60%），持续时间长（3～4h），酸度和胃蛋白酶的含量也很高（但比头期低），消化能力较强（B对）。头期胃液分泌的特点是持续时间长，分泌量多，酸度和胃蛋白酶含量很高。肠期胃液分泌的特点是胃液量少，酸度不高，消化力较弱。